慢性肾脏病（CKD）4期是指
A. GFR15～29ml/（min·173m2）
B. GFR≥60ml/（min·173m²）
C. GFR＜15ml/（min·173m²）
D. GFR＜10ml/（min·173m²）
E. GFR50～59ml/（min·173m²）

正确答案：A。GFR15～29ml/（min·173m2）

解析：GFR（肾小球滤过率）正常值为90～110ml/（min·1.73m²）。目前国际公认的慢性肾脏病分期依据美国肾脏基金会制定的指南分为1～5期，1期：GFR≥90ml/（min·1.73m²）；2期：GFR60～89ml/（min·1.73m²）；3a期：GFR45～59ml/（min·1.73m²）；3b期：GFR30～44ml/（min·1.73m²）；4期：GFR15～29ml/（min·1.73m²）（A对）；5期GFR＜15ml/（min·1.73m²）或透析。